进口药品批准证明文件有效期满后申请人拟继续进口的药品属于
A. 新药申请
B. 仿制药申请
C. 进口药品申请
D. 补充申请
E. 再注册申请

正确答案：E。再注册申请

解析：本题考查药品注册申请。进口药品批准证明文件有效期满后申请人拟继续进口的药品属于再注册申请（E对）。新药申请（A错）是指未曾在中国境内上市销售的药品的注册申请。仿制药申请（B错）是指生产国家食品药品监督管理总局已批准上市的已有国家标准的药品的注册申请。进口药品申请（C错）是指在境外生产的药品在中国境内上市销售的注册申请。补充申请（D错）是指新药申请、仿制药的申请或者进口药品申请经批准后，改变、增加或取消原批准事项或内容的注册申请。